患者，男，50岁，诊断为高血压、冠心病。医师处方，氨氯地平片10mg，po，qd；美托洛尔缓释片47.5mg，po，qd；贝那普利片20mg，po，qd；阿司匹林肠溶片100mg，po，qd；辛伐他汀片40mg，po，qd。该患者治疗后出现肌肉酸痛，实验室检查提示：肌酸激酶（CK）2000U/L，应考虑停用的药物是
A. 氨氯地平片
B. 美托洛尔缓释片
C. 贝那普利片
D. 阿司匹林肠溶片
E. 辛伐他汀片

正确答案：E。辛伐他汀片

解析：本题考查血生化检查。该患者治疗后出现肌肉酸痛，实验室检查提示：肌酸激酶（CK）2000U/L，应考虑停用的药物是辛伐他汀片（E对）。辛伐他汀片为羟甲戊二酰辅酶A还原酶抑制剂，服用 后可增加肌病的发生危险，表现为肌酸激酶升高。氨氯地平（A错）为钙通道阻滞剂，其主要不良反应是踝部水肿、头痛及面部潮红。美托洛尔（B错）为β受体阻断剂，其不良反应主要是支气管痉挛。贝那普利（C错）为ACEI类抗高血压药，最常见的不良反应是持续性干咳。阿司匹林肠溶片（D错）为解热镇痛药，常见不良反应为胃肠道反应。